17223-2012）要求，1～2年级、3～6年级小学生以及中学生每天睡眠时间分别不宜少于
A. 12小时，11小时，10小时
B. 11小时，10小时，9小时
C. 10小时，9小时，8小时
D. 9小时，8小时，7小时
E. 8小时，7小时，6小时

正确答案：C。10小时，9小时，8小时